甲状腺功能亢进时出现的Graefe眼征是
A. 眼球下转时上睑不能相应下垂
B. 瞬目减少
C. 辐辏运动减弱
D. 上视时无额纹出现
E. 双侧眼球突出

正确答案：A。眼球下转时上睑不能相应下垂

解析：Graefe眼征是由于甲状腺合成释放过多的甲状腺激素，造成机体代谢亢进和交感神经兴奋，引起心悸、出汗、进食和便次增多和体重减少的病症。多数患者还常常同时有突眼、眼睑水肿、视力减退等症状眼球下转时上睑不能相应下垂（A对）为Graefe眼征。瞬目减少（B错）为Stellwag征。辐辏运动减弱（C错）常见于动眼神经损害导致的睫状肌和眼内直肌麻痹。上视时无额纹出现（D错）为Joffroy征。双侧眼球突出（E错）常见于甲状腺功能亢进症的患者，单侧眼球突出，多见于局部炎症或眶内占位性病变，偶见于颅内病变。